关于DNA聚合酶的叙述错误的是
A. 需模板DNA
B. 需引物RNA
C. 延伸方向为5′→3′
D. 以NTP为原料
E. 具有3′→5′外切酶活性

正确答案：D。以NTP为原料

解析：DNA聚合酶全称是依赖DNA的DNA聚合酶，主要催化DNA复制。DNA复制是酶促核苷酸聚合反应，真核生物的底物是dNTP，原核生物的底物是NTP（D错，为本题的正确答案），DNA复制还需模板DNA（A对）、引物RNA（B对），遵照碱基互补配对的原则，按照模板合成子链，延伸方向为5′→3′（C对）。原核生物的DNA pol I和真核生物的DNA polδ的3＇→5＇核酸外切酶活性都很强（E对），可以在复制过程中辨认并切除错配的碱基，对复制错误进行校正，具有错配修复的作用。